治疗积滞，脾虚挟积的首选方剂是
A. 资生健脾丸
B. 疳积散
C. 健脾丸
D. 曲麦枳洙丸
E. 参苓白术散

正确答案：C。健脾丸

解析：积滞脾虚夹积的证候是面色萎黄，形体消瘦，神疲肢倦，不思乳食，食则饱胀，腹满喜按，大便稀溏酸腥，夹有乳片或不消化食物残渣，舌质淡，苔白腻，脉细滑，或指纹淡滞。治法：健脾助运，消食化滞。方药：健脾丸加减（C对）。资生健脾丸具有健脾开胃，消食止泻，调和脏腑，滋养营卫之功效。主治胃脾虚弱，食不运化，胸脘饱满，面黄肌瘦，大便溏泄，以及妇人妊娠呕吐，小儿疳积，神疲便溏（A错）。疳积散具有消积化滞之功效。主治食滞脾胃所致的疳症，症见不思乳食、面黄肌瘦、腹部膨胀、消化不良（B错）。曲麦枳术丸健脾消食。用于脾虚停滞，脘腹痞满，倒饱嘈杂，不思饮食（D错）。参苓白术散健脾益气，佐以助运，治疗厌食脾胃气虚证（E错）。